世界上第一个安乐死合法化的国家是
A. 澳大利亚
B. 挪威
C. 比利时
D. 新西兰
E. 荷兰

正确答案：E。荷兰

解析：本题考查世界上第一个安乐死合法化的国家。世界上第一个安乐死合法化的国家是荷兰（E对）。2001年，荷兰议会上议院通过了《根据请求终止生命和帮助自杀（审查程序）法》，使荷兰成为了全世界第一个允许安乐死的国家。2002年，比利时立法，允许医生在特殊情况下，在符合实施安乐死的前提和要求时可以对患者实行安乐死，成为继荷兰之后第二个使安乐死合法化的国家。